中毒型细菌性痢疾多见于
A. 2～7岁体格健壮的小儿
B. 3～6个月体格健壮的婴幼儿
C. 低出生体重儿
D. 8～10岁营养状况较差的儿童
E. 12～14岁青春期儿童

正确答案：A。2～7岁体格健壮的小儿

解析：中毒型细菌性痢疾是由志贺菌属引起的肠道传染病，夏秋多见，多见于体格健壮的小儿，发病年龄以2～7岁多见（A对）。